解救有机磷农药中毒宜选用的药物是
A. 新斯的明
B. 阿托品
C. 多巴胺
D. 异丙肾上腺素
E. 酚妥拉明

正确答案：B。阿托品

解析：本题考查有机磷中毒解救。解救有机磷农药中毒宜选用的药物是阿托品（B对）。阿托品能拮抗乙酰胆碱的毒蕈碱样作用，提高机体对乙酰胆碱的耐受性。阿托品的临床应用：解除平滑肌痉挛；解救有机磷中毒；抗休克；抑制腺体分泌；眼科检查眼底；缓慢性心律失常。新斯的明（A错）用于治疗重症肌无力，手术结束时拮抗非去极化肌肉松弛药的残留肌松作用，麻痹性肠梗阻和术后尿潴留。多巴胺（C错）用于心肌梗死、创伤、内毒素败血症、心脏手术、肾功能衰竭、充血性心力衰竭等引起的休克综合征。异丙肾上腺素（D错）用于治疗心源性或感染性休克，完全性房室传导阻滞、心搏骤停。盐酸异丙肾上腺素气雾剂：用于治疗支气管哮喘。酚妥拉明（E错）用于血管痉挛性疾病，如肢端动脉痉挛症(即雷诺病）、手足发绀症等、感染中毒性休克以及嗜铬细胞瘤的诊断试验等。